大豆中具有抗氧化作用的是
A. PHA
B. 亚油酸
C. 赖氨酸
D. 植物红细胞凝血素
E. 大豆异黄酮

正确答案：E。大豆异黄酮